女，30岁，近2个月中度发热，全身肌痛，四肢关节肿痛，口腔溃疡。尿常规示红细胞（+）/高倍视野，蛋白（++）。最可能的诊断是
A. 类风湿关节炎
B. 败血症
C. 皮肌炎
D. 系统性红斑狼疮
E. 急性肾小球肾炎

正确答案：D。系统性红斑狼疮

解析：育龄女性患者（系统性红斑狼疮好发人群），出现中度发热、全身肌痛、四肢关节肿痛、口腔溃疡（系统性红斑狼疮典型表现），尿常规提示血尿、蛋白尿（系统性红斑狼疮肾损害），考虑患者最可能诊的断为系统性红斑狼疮（D对）。类风湿性关节炎（A错）关节肿痛多累及腕、掌指、近端指间关节等小关节，且很少累及肾（P808）。败血症（B错）多急性起病，有局部感染表现，全身表现有寒战、高热、肝脾肿大，如不及时治疗可危及生命，不会迁延2个月。皮肌炎（C错）诊断标准为：①对称性四肢近端肌无力；②肌酶谱升高；③肌电图示肌源性改变；④肌活检异常；⑤皮肤特征性表现。前4条具备3条加第5条为确诊皮肌炎（八版内科学P844），一般无口腔溃疡表现。急性肾小球肾炎（E错）多见于儿童，起病急，典型者呈急性肾炎综合征表现，即血尿、蛋白尿、水肿、高血压及肾功能异常，无四肢关节肿痛及口腔溃疡。